筛检效果评价中的常见偏倚不包括
A. 领先时间偏倚
B. 病程长短偏倚
C. 回忆偏倚
D. 过度诊断偏倚
E. 志愿者偏倚

正确答案：C。回忆偏倚

解析：本题考查筛检效果评价中常见的偏倚。筛检效果评价中的常见的偏倚有：1.领先时间偏倚（A对）；2.病程偏倚（B对）；3.志愿者偏倚（E对）；4.过度诊断偏倚（D对）。回忆偏倚（C错，为本题正确答案）是由于研究对象对暴露史或既往史回忆的准确性和完整性存在系统误差而引起的偏倚，常见于病例对照研究中。